关于生态系统的服务功能，不正确的是
A. 是人类力量无法取代的
B. 包括生态系统的产品和服务
C. 包括提供食物、水和氧气等
D. 不包括控制疾病
E. 包括精神、娱乐和文化收益

正确答案：D。不包括控制疾病

解析：本题考查生态系统的服务功能。生态系统服务指对人类生存与生活质量有贡献的所有生态系统产品和服务（B对），包括人类从生态系统获得的所有惠益，如供给服务（如提供食物、水和氧气等）（C对）、调节服务（如控制疾病（D错，为本题正确答案）和调节气候），文化服务（如精神、娱乐和文化收益）（E对）以及支持服务（如维持地球生命生存环境的养分循环）。自然生态系统还具有净化污染、涵养水源、保持水土、防风固沙、减轻灾害、保护生物多样性等功能，进而为人类的生存与发展提供良好的生态环境。 这些物质的和精神的、有形的和无形的服务，是难以用经济价值衡量的，往往是人类的力量无法替代的（A对）。